腭裂伴有单侧或双侧唇裂约占
A. 0.6
B. 0.7
C. 0.8
D. 0.9
E. 1

正确答案：C。0.8

解析：腭裂：是口腔较常见的一种畸形，为侧腭突和鼻中隔未融合或部分融合的结果。腭裂可发生于单侧，也可发生于双侧。约80%的腭裂患者伴有单侧或双侧唇裂。掌握“腭部与舌的发育”知识点。